运用队列研究研究吸烟和肺癌的关系，基线资料收集研究对象的年龄、性别和其他人口学资料的目的是
A. 根据年龄、性别制订不同随访方案
B. 根据年龄、性别进行分组
C. 排除具有可疑混杂因素的研究对象
D. 为调整可疑混杂因素的影响收集资料
E. 判断研究对象的依从程度

正确答案：D。为调整可疑混杂因素的影响收集资料

解析：本题考查收集基线资料的目的。基线资料一般包括待研究的暴露因素的暴露状况，疾病与健康状况，年龄、性别、职业、文化、婚姻等个人状况，家庭环境、个人生活习惯及家族疾病史等。收集这些资料一方面可作为判定暴露组与非暴露组的依据，也为今后仔细分析和调整其他影响研究结局的因素提供保证（D对ABCE错）。